哪项不是宿主的固有免疫
A. 体液免疫
B. 屏障结构
C. 吞噬细胞
D. 非特异性体液因素
E. 细胞因子

正确答案：A。体液免疫